患儿3岁，近1年多，哭甚时出现青紫，查体：心前区隆起，胸骨左缘第3～4肋间可闻及Ⅳ级收缩期杂音，可触及震颤，X线检查示：左右心室及左房增大，肺血管影增多，肺动脉段凸出。此患儿最可能的诊断是
A. 房间隔缺损
B. 室间隔缺损
C. 肺动脉狭窄
D. 动脉导管未闭
E. 法洛氏四联症

正确答案：B。室间隔缺损

解析：患儿3岁，近1年多，哭甚时出现青紫，查体：心前区隆起，胸骨左缘第3-4肋间可闻及Ⅳ级收缩期杂音，可触及震颤，X线检查示：左右心室及左房增大，肺血管影增多，肺动脉段凸出等符合室间隔缺损时胸骨左缘第3、4肋间可闻及Ⅲ-Ⅳ级粗糙的全收缩期杂音，向四周广泛传导，可扪及收缩期震颤的临床表现及左、右心室增大及肺动脉段明显突出的X线检查结果（B对）。而房间隔缺损（A错）症状出现的早晚喝轻重取决于缺损大小，缺损小的可无症状，仅在体检时发现胸骨左缘第2-3肋间有收缩期杂音；缺损较大时可导致肺充血、体循环血流量不足，表现为体型瘦长、面色苍白、乏力、多汗、活动后气促和生长发育迟缓。多数患儿在婴幼儿期无明显体征，以后心脏增大，前胸饱满，搏动活跃，少数大缺损可扪及震颤，听诊时第一心音亢进，肺动脉第二心音增强等，故该患儿不考虑此病。肺动脉狭窄（C错）生长发育多正常，半数患儿面容硕圆，大多无青紫，面颊和指端可能暗红，狭窄严重者可有青紫。患儿心前区可较饱满，有严重狭窄伴有心力衰竭时心脏扩大，左侧胸骨旁可摸得右心室的抬举性搏动，在心前区搏动弥散，故该患儿不考虑此病。动脉导管未闭（D错）的患儿在婴幼儿期可有咳嗽、气急、喂养困难、体重不增、生长发育落后等，其胸骨左缘上方有一连续性“机器”样杂音，占整个收缩期与舒张期，常伴有震颤。大分流量者心胸比率增大，左心室增大，心尖向下扩张，肺血增多，肺动脉段突出等，故该患儿不考虑此病。法洛氏四联症（E错）的临床表现主要有青紫、蹲踞症状、杵状指（趾）及阵发性缺氧发作，患儿心前区略隆起，胸骨左缘第2-4肋间可闻及Ⅱ-Ⅲ级粗糙喷射性收缩期杂音等，心脏大小一般正常或稍增大，典型者前后位心影呈“靴状”，故该患儿不考虑此病。